舌红少津少苔而颤动的临床意义是
A. 血虚动风
B. 热极生风
C. 阴虚动风
D. 疫毒攻心
E. 肝阳化风

正确答案：C。阴虚动风

解析：舌红少津少苔而颤动的多属阴虚动风（C对）。久病舌淡白而颤动者，多属血虚动风（A错）。新病舌绛而颤动者，多属热极生风（B错）。吐舌可见于疫毒攻心，或正气已绝（D错）。舌红少津而颤动者，多属阴虚动风、肝阳化风；肝阳化风证的舌象为舌红苔腻（E错）。